小脑幕切迹疝的最典型表现是
A. 昏迷、一侧瞳孔散大、对侧肢体偏瘫
B. 一侧肢体偏瘫
C. 一侧瞳孔散大、同侧肢体偏瘫
D. 剧烈头痛
E. 呼吸抑制、双侧肢体肌张力下降

正确答案：A。昏迷、一侧瞳孔散大、对侧肢体偏瘫

解析：发生小脑幕切迹疝时，移位的脑组织在小脑幕切迹挤压脑干，使脑干内网状上行激动系统受累，病人发生嗜睡、昏迷，患侧的大脑脚受到挤压而造成病变对侧偏瘫，患侧动眼神经受到挤压导致动眼神经麻痹，患侧瞳孔散大（A对）。